有关血栓的论述，错误的是
A. 静脉血栓多于动脉血栓
B. 下肢血栓多于上肢
C. 动脉瘤内血栓多为混合血栓
D. 静脉内血栓尾部多为红色血栓
E. 毛细血管内血栓多为白色血栓

正确答案：E。毛细血管内血栓多为白色血栓

解析：静脉的血流速度较动脉缓慢，故易形成血栓，临床上静脉血栓多于动脉血栓（A对）。下肢静脉比上肢静脉长，故下肢静脉循环时间较长，同时重力作用使血液回流速度缓慢，故下肢静脉比上肢静脉更容易形成血栓（B对）。发生于动脉瘤内的血栓为附壁血栓，属于混合血栓（C对）。静脉内血栓尾部多为红色血栓（D对）。毛细血管内血栓多为透明血栓（E错，为本题正确答案）。